对牙槽嵴损害最小的人工牙是
A. 解剖式瓷牙
B. 非解剖式塑料牙
C. 解剖式塑料牙
D. 半解剖式瓷牙
E. 半解剖式金属（牙合）面牙

正确答案：B。非解剖式塑料牙

解析：非解剖式牙：人工牙的颊、舌轴面与解剖式牙类似，但（牙合）面仅有溢出沟，而没有牙尖，或者说牙尖斜度为0°，又称无尖牙。无尖牙咀嚼效率较低，但侧向（牙合）力小，有利于义齿稳定，对牙槽骨的损害小。掌握“局部义齿人工牙及基托”知识点。